乳房干板静电摄影技术最重要的优点是
A. 血管影特别清晰
B. 肿块边缘更为清晰
C. 钙化影更为清晰
D. 乳房腺叶更为清晰
E. 乳管影更为清晰

正确答案：B。肿块边缘更为清晰

解析：乳房干板静电摄影即硒静电X线摄影，是一种常用的乳腺摄影方法。由于干板照相是利用硒表面所带的电荷来达到显影的目的，而电荷的体积较普通胶片的银粒要小的多，因此干板照相的分辨率要比普通胶片的要高。此外静电摄影的电位差还可以加深不同密度组织之间分界面上的影像，形成“边缘效应”，使图像更加醒目。这种效应使微小病变易于检出，提高了早期乳腺癌的发现率。干板照相的优点是对钙化点的分辨率较高，但X线计量较大。肿块边缘更为清晰（B对）。